可呈片状、贯穿整个釉质厚度的结构缺陷是
A. 釉板
B. 釉丛
C. 釉梭
D. 牙面平行线（釉质横纹）
E. 生长线

正确答案：A。釉板

解析：釉板是片状、贯穿整个釉质厚度的结构缺陷，自釉质表面延伸至釉质不同的深度，可达釉牙本质界。掌握“牙釉质”知识点。